宜于餐前0.5～1小时服用的胃黏膜保护药是
A. 奥美拉唑
B. 地塞米松
C. 枸橼酸铋钾
D. 阿托品
E. 三硅酸镁

正确答案：C。枸橼酸铋钾

解析：本题考查胃黏膜保护药。枸橼酸铋钾（C对）为铋剂类胃黏膜保护剂，在酸性环境中能形成高黏度溶胶，该溶胶与溃疡面及炎症表面有较强亲和力，可在胃黏膜表面形成一层牢固的保护膜。餐前0.5～1小时服用，可以保护胃黏膜免受食物的刺激。奥美拉唑（A错）为抑酸剂，其用法用量为：口服：（1）用于胃、十二指肠溃疡，单剂量20mg清晨顿服，十二指肠溃疡疗程2-4周，胃溃疡疗程4-8周；用于难治性消化性溃疡，一次20mg，一日2次，或一次40mg，一日1次。（2）用于胃食管反流病，单剂量20-60mg晨起顿服或早、晚各一次，疗程4-8周。（3）用于卓-艾综合症，初始剂量为一次60mg，一日1次，以后酌情调整为一日20～120mg，如剂量大于一日80mg，则应分2次给药，其疗程视临床情况而定。地塞米松（B错）口服：初始一次0.75-3mg，一日2-4次，维持量一日0.75mg，剂量可视病情酌情而定。阿托品（D错）可肌肉、静脉、皮下注射，也可口服，口服时一日3次，无明确餐前服用要求；三硅酸镁（E错）为抗酸药，也可保护胃黏膜，抗酸药起效快，可在症状发作（胃灼烧感、反酸等）时服用，也可以在餐前1h服用。